服药后1小时内限制饮水的药品是
A. 微生态制剂
B. 胃黏膜保护剂
C. 磺胺类药物
D. 头孢菌类药物
E. 抗高血压药

正确答案：B。胃黏膜保护剂

解析：本题考查限制饮水的药物。胃黏膜保护剂（B对）服药后1小时内限制饮水，避免保护层被水冲掉。服用磺胺类药物（C错）时宜大量喝水。微生态制剂（A错）、头孢菌类药物（D错）、抗高血压药（E错）对饮水无特殊要求。